原动物属于鲍科的药材是
A. 地龙
B. 蛤蚧
C. 全蝎
D. 石决明
E. 蜈蚣

正确答案：D。石决明

解析：本题考查的是石决明的来源。原动物属于鲍科的药材是石决明（D对）。石决明：【来源】为软体动物门鲍科动物杂色鲍（九孔鲍）、皱纹盘鲍、羊鲍、澳洲鲍、耳鲍或白鲍的贝壳。地龙（A错）：【来源】为环节动物门钜蚓科动物参环毛蚓、通俗环毛蚓、威廉环毛蚓或栉盲环毛蚓的干燥体，前一种习称“广地龙”，后三种习称“沪地龙”。蛤蚧（B错）：【来源】为脊索动物门爬行纲壁虎科动物蛤蚧除去内脏的干燥体。全蝎（C错）：【来源】为节肢动物门蛛形纲钳蝎科动物东亚钳蝎的干燥体。蜈蚣（E错）：【来源】为节肢动物门多足纲蜈蚣科动物少棘巨蜈蚣的干燥体。